重金属检查法（第一法）所使用的试剂有
A. 盐酸
B. 醋酸盐缓冲液（pH3.5）
C. 碘化钾试液
D. 硫代乙酰胺试液
E. 硫化钠试液

正确答案：B、D。醋酸盐缓冲液（pH3.5）；硫代乙酰胺试液

解析：本题考查重金属检查法。重金属检查法（第一法）所使用的试剂有醋酸盐缓冲液（pH3.5）（B对）、硫代乙酰胺试液（D对）。第一法为硫代乙酰胺法，该法适用于溶于水、稀酸和乙醇的药物，为最常用的方法。其原理为：硫代乙酰胺法在弱酸性（pH为3.5的乙酸盐缓冲液）条件下水解，产生硫化氢与微量重金属离子，生成黄色到棕黑色的硫化物均匀混悬液，与一定量的标准铅溶液经同法处理后所呈的颜色比较，判定供试品中的重金属是否符合限量规定。盐酸（A错）可能会出现在供试品中，一般不超过1ml，也可不加。重金属检查法一般不会用到碘化钾试液（C错）。硫化钠试液（E错）为第三法使用的显色剂。